下列预防职业病的措施，属于第一级预防
A. 定期体检
B. 及时治疗
C. 以低毒原料代替高毒原料以减少职业病的发生
D. 定期检查工作设备和环境
E. 轮换休息

正确答案：C。以低毒原料代替高毒原料以减少职业病的发生

解析：职业病预防应遵循三级预防原则。第一级预防又称病因预防，从根本上阻止职业性有害因素对人体的损害作用。通过生产工艺改革和生产设备改进，合理利用防护设施及个人防护用品，使劳动者尽可能不接触职业性有害因素，或控制作业场所有害因素水平在卫生标准允许限度内。以低毒原料代替高毒原料以减少职业病的发生属于从根本上阻止职业性有害因素对人体的损害作用，即属于第一级预防（C对）。第二级预防又称发病预防，对作业人群实施职业健康监护（A错）、早期发现职业损害，及时合理处理、有效治疗（B错）、防止病情进一步发展。